锌最好的食物来源是
A. 贝壳类海产品
B. 蔬菜
C. 精制米面
D. 牛奶
E. 水果

正确答案：A。贝壳类海产品